消糖灵胶囊引起的不良反应是
A. 嗜睡乏力
B. 低血糖
C. 视觉异常
D. 出血
E. 骨质疏松

正确答案：B。低血糖

解析：本题考查消糖灵胶囊的不良反应。消糖灵胶囊重复使用可引起低血糖反应、恶心、呕吐、腹泻、食欲缺乏、皮疹。